诊断钩端螺旋体病的血清学检查方法为
A. 肥达试验
B. 外斐试验
C. 补体结合试验
D. 显微镜凝集溶解试验
E. 红细胞溶解试验

正确答案：D。显微镜凝集溶解试验

解析：肥达试验（A错）是一种试管凝集反应，用已知的伤寒杆菌O、H抗原和甲、乙型副伤寒杆菌H抗原，与待测血清作试管或微孔板凝集实验，以测定血清中有无相应抗体存在，作为伤寒、副伤寒诊断的参考。外斐试验（B错）用于辅助诊断立克次体病，变形杆菌属菌株的菌体O抗原与斑疹伤寒立克次体和恙虫病的虫体有共同抗原，故可用这些菌株的O抗原代替立克次体抗原与患者血清进行交叉凝集反应，检测患者血清中相应抗体。补体结合试验（C错）是利用抗原抗体复合物同补体结合，把含有已知浓度的补体反应液中的补体消耗掉使浓度减低的现象，以检出抗原或抗体的试验，用于检查梅毒。显微镜凝集溶解实验（D对）是用钩端螺旋体标准株或者当地流行菌株的活体做特异性抗原，分别与病人不同稀释度的血清混合，在37°孵育2小时后用暗视野显微镜观察，若待测血清中有相应抗体，则可见钩端螺旋体凝集成小蜘蛛状。红细胞溶解试验（E错）可用于病毒抗体的检出。